医师在执业活动中违反技术操作规范，造成严重后果的，给予警告或者责令暂停执业活动
A. 3个月至6个月
B. 6个月至1年
C. 6个月至1年半
D. 1年至1年半
E. 1年至2年

正确答案：B。6个月至1年

解析：医师在执业活动中，有下列行为之一的，由县级以上地方人民政府卫生行政部门给予警告或者责令暂停6个月以上1年以下执业活动；情节严重的，吊销其执业证书；构成犯罪的，依法追究刑事责任：违反卫生行政规章制度或技术操作规范，造成严重后果的。掌握“医师执业规则及培训、考核及法律责任”知识点。